以夏科（charcot）三联征为典型表现的疾病是
A. 急性憩室炎
B. 急性出血性胰腺炎
C. 急性胆管炎
D. 急性胆囊炎
E. 先天性胆管扩张症

正确答案：C。急性胆管炎

解析：以夏科（Charcot）三联症为典型表现的疾病是急性胆管炎（C对）。急性憩室炎典型表现为局部压痛、发热，但无黄疸（A错）。急性出血性胰腺炎（P457）的典型表现是腹痛（多为饱食或饮酒后突然发作）、腹胀、恶心呕吐、腹膜炎体征（B错）。急性胆囊炎（D错）主要表现为上腹部疼痛，通常无寒战、黄疸。先天性胆管扩张症（E错）的典型临床表现是腹痛、腹部肿块、黄疸。